有头疽切开引流常作
A. 对口引流
B. 一字形切口
C. 十字形切口
D. 梭形切口
E. S型切口

正确答案：C。十字形切口

解析：有头疽的局部治疗：初起可用理疗、药物外敷。成脓后切开引流。切开时行“十”字或双“十”字切口才能使引流通畅彻底（C对）。切开后应尽量彻底清除脓液和切除坏死组织，每日换药。如创面过大，待肉芽生长良好时及时植皮，可缩短疗程。